高热、头痛、呕吐，全身皮肤散在瘀点，颈项僵直，最有可能诊断是
A. 结核性脑膜炎
B. 流行性脑脊髓膜炎
C. 流行性乙型脑炎
D. 伤寒
E. 细菌性痢疾

正确答案：B。流行性脑脊髓膜炎

解析：患者表现为高热、头痛、呕吐，全身皮肤散在瘀点（提示可能存在败血症，可见于流行性脑脊髓膜炎败血症期），颈项僵硬（脑膜刺激征提示颅内存在病变，佐证流行性脑脊髓膜炎可能），故最可能的诊断是流行性脑脊髓膜炎（B对）。结核性脑膜炎多有结核病史或密切接触史，起病缓慢，长期午后低热，可有倦怠、盗汗、食欲下降、体重减轻等全身症状，神经系统症状出现晚，无瘀点、瘀斑，脑脊液以单核细胞为主（A错）。流行性乙型脑炎是由嗜神经病毒乙脑病毒感染所致，常流行于夏秋季，临床上以高热、意识障碍、抽搐、病理反射及脑膜刺激征为特征，血常规白细胞总数增高，中性粒细胞增高，但不会出现全身皮肤散在瘀点、瘀斑（C错）。伤寒临床特征为持续发热、表情淡漠、相对缓脉、玫瑰疹、肝脾大和白细胞减少等（D错）。细菌性痢疾的主要病理变化在直肠、乙状结肠的炎症与溃疡，主要表现为腹痛、腹泻、排黏液脓血便以及里急后重等，可伴有发热及全身毒血症状，严重者可出现感染性休克和（或）中毒性脑病（E错）。